食管疾病的胸痛特点是
A. 精神紧张诱发
B. 含化硝酸甘油减轻
C. 呼吸时加重，屏气时消失
D. 压迫加剧
E. 进食加剧

正确答案：E。进食加剧

解析：食管疾病导致的胸痛是指由食管疾病或食管功能障碍引起的胸痛，表现为烧心伴胸骨后或胸骨下发作性疼痛，进食时发作或加剧，服用抗酸剂或促动力药物可减轻或消失（E对）。精神紧张诱发是指精神紧张状态导致的脏器血供相对不足，多见于心绞痛，也可见于食管疾病（A错）。含化硝酸甘油减轻是心绞痛的胸痛特点（B错）。呼吸时加重，屏气时消失是指呼吸时胸膜摩擦而疼痛加重，是结核性胸膜炎以及心包炎的特点（C错）。压迫加剧见于多种可致胸痛的疾病（D错）。